能引起致死性肺毒性和肝毒性的抗心律失常药是
A. 奎尼丁
B. 胺碘酮
C. 普萘洛尔
D. 利多卡因
E. 维拉帕米

正确答案：B。胺碘酮

解析：本题考查胺碘酮的不良反应。胺碘酮（B对）常见的不良反应有肝功能异常与肺毒性。奎尼丁（A错）常见不良反应是胃肠道反应和中枢神经系统反应。普萘洛尔（C等）常见不良反应有窦性心动过缓、房室传导阻滞、低血压、心力衰竭等。利多卡因（D错）常见不良反应是神经系统反应。维拉帕米（E错）常见的不良反应是低血压。